阳明经头痛的特征是
A. 前额连眉棱骨痛
B. 头两侧太阳穴处痛
C. 后头部连项痛
D. 头痛连齿
E. 颠顶痛

正确答案：A。前额连眉棱骨痛

解析：阳明头痛，指邪气侵犯阳明经而引起的头痛。一般阳明头痛，在前额部及眉棱骨等处（A对）。少阳经起于目外眦，上抵头角，行于头侧部，故头两侧太阳穴处痛（B错），病在少阳经。太阳经与督脉行于头后，故后头连项痛（C错），病在太阳经。齿为肾之余，足少阴经络肾，头痛连齿（D错）为少阴经头痛的特征。足厥阴肝经系目系，与督脉络于巅，行于巅顶部，故巅顶痛（E错），病在厥阴经。